关于女性外生殖器解剖，正确的是
A. 女性外生殖器即外阴
B. 女性阴毛分布呈棱形
C. 双侧小阴唇前端为腹股沟韧带终止点
D. 前庭大腺开口于阴道内
E. 阴道前庭为双侧大阴唇之间的菱形区

正确答案：A。女性外生殖器即外阴

解析：女性外生殖器指生殖器的外露部分，位于两股内侧间，前为耻骨联合，后为会阴，包括阴阜、大阴唇、小阴唇、阴蒂和阴道前庭，统称为外阴（A对）。阴毛呈倒三角形分布（B错）。双侧小阴唇前端融合，并分为前后两叶，前叶形成阴蒂包皮，后叶形成阴蒂系带。腹股沟韧带起于髂前上棘，止于耻骨结节（C错）。前庭大腺开口于阴道前庭后方小阴唇与处女膜之间的沟内（D错）。阴道前庭为一菱形区，前为阴蒂，后为阴唇系带，两侧为小阴唇（E错）。